三边孔
A. 上界为大圆肌
B. 下界为小圆肌
C. 内侧界为肱三头肌
D. 有旋肩胛血管穿过
E. 有旋肱后血管穿过

正确答案：D。有旋肩胛血管穿过

解析：三边孔上界为小圆肌和肩胛下肌，而非大圆肌（A错）；下界为大圆肌和背阔肌，而非小圆肌（B错）；肱三头肌为其外侧界，而非内侧界（C错）；有旋肩胛血管穿过（D对）；无旋肱后血管穿过（E错）。